吐温类表面活性剂具有
A. 增溶作用
B. 助溶作用
C. 润湿作用
D. 乳化作用
E. 润滑作用

正确答案：A、C、D。增溶作用；润湿作用；乳化作用

解析：本题考查表面活性剂。吐温类表面活性剂具有增溶作用（A对）、润湿作用（C对）、乳化作用（D对）。吐温类表面活性剂又称聚山梨脂，为非离子表面活性剂，可作为乳化剂、增溶剂、分散剂和润湿剂；吐温不具有助溶作用（B错）、润滑作用（E错）。